头痛用白芷治疗，以病在下列哪条经脉为主
A. 厥阴经
B. 阳明经
C. 太阳经
D. 少阴经
E. 少阳经

正确答案：B。阳明经

解析：白芷入阳明经，可以治疗阳明经头痛（B对）。厥阴经（A错）头痛的引经药是吴茱萸。太阳经（C错）头痛的引经药是川芎。少阴经（D错）头痛的引经药是苍术。少阳经（E错）头痛的引经药是柴胡。